影响戒烟行为的促成因素为
A. 法规如公共场所禁烟
B. 吸烟危害知识
C. 个人价值观
D. 有关吸烟危害的态度、信念
E. 同伴的支持

正确答案：A。法规如公共场所禁烟